癫痫全面性强直-阵挛发作的治疗，不正确的是
A. 慎防舌咬伤
B. 及时松解衣物
C. 抽搐时间长者可不予药物治疗
D. 精神症状发作者应防止自伤
E. 抽搐时间长者可给与苯巴比妥钠0.2g肌内注射

正确答案：C。抽搐时间长者可不予药物治疗

解析：癫痫发作时的一般处理：对全面强直-阵挛性发作患者，要注意防止跌伤和碰伤，解松衣领及裤带（B对），保持呼吸道通畅。将毛巾、手帕或外裹纱布的压舌板塞入齿间，以防舌咬伤（A对）。抽搐时不可过分按压患者肢体，以免发生骨折或脱臼。阵挛后期，将头部转向一侧，让分泌物及呕吐物流出口腔，以防止窒息。如抽出时间过长，或当日已有发作，可给与苯巴比妥钠0.2g肌内注射（E对）。对精神症状发作者，应防止其自伤或伤人（D对）（C错，为本题正确答案）。